医疗机构在药品购销中暗中收受回扣或者其他利益，依法对其给予罚款处罚的机关是
A. 卫生行政部门
B. 药品监督管理部门
C. 工商行政管理部门
D. 劳动保障行政部门
E. 中医药管理部门

正确答案：C。工商行政管理部门

解析：医疗机构在药品销售中暗中给予、收受回扣或者其他利益的，由工商行政管理部门（C对）处1万元以上20万元以下的罚款，有违法所得的，予以没收；构成犯罪的，依法追究刑事责任。